主含右旋龙脑的药材是
A. 海金沙
B. 青黛
C. 儿茶
D. 天然冰片
E. 五倍子

正确答案：D。天然冰片

解析：本题考查的是天然冰片的成分。主含右旋龙脑的药材是天然冰片（D对）。天然冰片为樟科植物樟的新鲜枝、叶经提取加工制成的结晶，习称“右旋龙脑”。为白色结晶性粉末或片状结晶。海金沙（A错）【成分】孢子含水溶性成分海金沙素，又含脂肪油，其主要脂肪酸为油酸、亚油酸、棕榈酸和肉豆蔻酸等。青黛（B错）【成分】马蓝制成的青黛含靛玉红、靛蓝、异靛蓝、靛黄、靛棕等。蓼蓝制成的青黛尚含靛苷、菘蓝苷、色氨酮、青黛酮等。儿茶（C错）【成分】含儿茶鞣质20%～50%，儿茶素2%～20%。还含表儿茶素、儿茶鞣红、槲皮素、树胶、低聚糖等。五倍子（E错）【成分】含五倍子鞣质，习称五倍子鞣酸，含量50%～70%，有的达78%。另含没食子酸2%～4%、白果酚、月桂酸、脂肪、树脂及蜡质等。